藻类毒性实验表明，表面活性剂毒性大小顺序为
A. 阳离子＞非离子型＝阴离子型
B. 非离子型＞阳离子＞阴离子型
C. 阴离子型＞阳离子＞非离子型
D. 阳离子＝非离子型＞阴离子型
E. 阳离子＞非离子型＞阴离子型

正确答案：E。阳离子＞非离子型＞阴离子型

解析：本题考查藻类毒性实验表明的表面活性剂毒性大小顺序。藻类毒性实验表明，表面活性剂毒性大小顺序为阳离子＞非离子型＞阴离子型（E对ABCD错）。